计算患病率的分子是
A. 观察期间某病的新发病例数
B. 观察期间某病的新旧病例数
C. 观察期间之前某病的患病人数
D. 观察期间某病的暴露人口数
E. 以上均不是

正确答案：B。观察期间某病的新旧病例数

解析：本题考查患病率的计算。患病率也称现患率，是指某特定时间内总人口中某病新旧病例（B对ACDE错）所占的比例，其计算公式为某观察期间某人群中某病的新旧病例数/同期的平均人口数。